患者女性，14岁，12岁月经初潮。月经周期紊乱，经期长短不一已有1年。肛门检查：子宫发育正常，双侧附件（-），最可能的诊断是
A. 黄体萎缩不全
B. 无排卵性功能失调性子宫出血
C. 子宫黏膜下肌瘤
D. 黄体功能不全
E. 子宫内膜息肉

正确答案：B。无排卵性功能失调性子宫出血

解析：月经周期紊乱，经期长短不一已有1年，双侧附件（-），考虑患者为青春期无排卵性功血。掌握“功能失调性子宫出血”知识点。